初孕妇，26岁。妊娠38周，自觉胎动减少10小时入院。5小时后，产程发动，听诊胎心率100次/分，此时最恰当的处理措施是
A. 加压给氧
B. 产钳助产
C. 给予宫缩抑制剂
D. 继续观察
E. 剖宫产

正确答案：E。剖宫产

解析：青年初产妇，妊娠38周（妊娠28周及以后为妊娠晚期），自觉胎动减少10小时（缺氧初期为胎动频繁，继而减弱及次数减少），产程发动后，胎心率100（正常110～160bpm，提示胎心率减少），说明胎儿缺氧，易发生胎儿窘迫，应立即剖宫产（E对D错）。加压给氧（A错）不能改善胎儿缺氧情况，故不是最恰当的措施。该孕妇5小时后，产程发动（P178）（潜伏期约需8小时，潜伏期胎头下降不显著），胎儿胎头还未进入骨盆，产钳助产（B错）无效。给予宫缩抑制剂（C错）适用于协调性宫缩乏力、宫口扩张≥3cm、胎心良好、胎位正常、头盆相称者，不适用于胎儿窘迫的情况。